适宜作为可溶片和泡腾片润滑剂的是
A. 甘露醇
B. 聚乙二醇
C. 硬脂酸镁
D. 羧甲淀粉钠
E. 滑石粉

正确答案：B。聚乙二醇

解析：本题考查的是片剂的润滑剂。适宜作为可溶片和泡腾片润滑剂的是聚乙二醇（B对）。聚乙二醇（PEG）：常用PEG 4000或PEG 6000，为水溶性润滑剂，适用于可溶片或泡腾片，用量为1%～4%。甘露醇（A错）：为白色结晶性粉末，清凉味甜，易溶于水；无引湿性，可压性好，是口含片的主要稀释剂和矫味剂，亦可作为咀嚼片的填充剂和黏合剂。硬脂酸镁（C错）：为白色细腻粉末。润滑性强，附着性好，但助流性差；具疏水性，用量大会影响片剂崩解，或产生裂片。用量一般为干颗粒的0.3%～1.0%。硬脂酸镁呈弱碱性，某些维生素及有机碱盐等遇碱不稳定的药物不宜使用。羧甲淀粉钠（D错）属于崩解剂。羧甲淀粉钠吸水后的膨胀率达原体积的300倍，其崩解作用十分显著。滑石粉（E错）：为白色结晶性粉未，其成分为含水硅酸镁。不溶于水，但具亲水性；助流性、抗黏着性良好，但附着性较差。多与硬脂酸镁等联合应用，以改善后者的疏水性，用量一般为2%～3%。由于颗粒细而比重大，附着力较差，在压片中可因振动易与颗粒分离并沉在颗粒底部，造成黏冲、片面色泽不均等问题，使用时应予以注意。